传染病的暴发调查常用指标
A. 罹患率
B. 患病率
C. 发病率
D. 续发率
E. 感染率

正确答案：A。罹患率

解析：本题考查罹患率的应用。罹患率（A对BCDE错）也是测量某人群某病例新病例发生频率的指标，通常指在某一局限范围短时间内的发病率。它的优点是能根据暴露程度较精确地测量发病频率，常常应用于食物中毒、职业中毒或传染病的暴发及流行中。